符合腹股沟直疝临床表现是
A. 极少发生嵌顿
B. 按压深环肿块不再复出
C. 疝囊颈位于腹壁下动脉外侧
D. 透光试验阳性
E. 易进入阴囊

正确答案：A。极少发生嵌顿

解析：符合腹股沟直疝临床表现的是极少发生嵌顿（A对）。按压深环肿块不再复出（B错），疝囊颈位于腹壁下动脉外侧（C错），易进入阴囊（E错）均为斜疝的临床表现。透光试验阳性（D错）见于睾丸鞘膜积液。